以上腧穴中，善于治疗口歪的是
A. 内关
B. 复溜
C. 太溪
D. 阴谷
E. 太冲

正确答案：E。太冲

解析：太冲属于足厥阴肝经腧穴，位于足背第1、2跖骨间，跖骨底结合部前方凹陷中。太冲主治中风、癫狂痫、小儿惊风、头痛、眩晕、耳鸣、目赤肿痛等肝经风热病证（E对）；月经不调、痛经、经闭、崩漏、带下、滞产等妇科病证；黄疸、胁痛、口苦、腹胀、呕逆等肝胃病证；癃闭，遗尿；下肢痿痹，足跗肿痛。内关主治心痛、胸闷、心动过速或过缓等心系病证；胃痛、呕吐、呃逆等胃腑病证；中风，偏瘫，眩晕，偏头痛；失眠、郁证、癫狂病等神志病证；肘、臂、腕挛痛（A错）。复溜主治水肿、汗证第十版针灸学（无汗或多汗）等津液输布失调病证；腹胀、腹泻、肠鸣等胃肠病证；腰脊强痛，下肢痿痹（B错）。太溪主治头痛、目眩、失眠、健忘、遗精、阳痿等肾虚证；咽喉肿痛、齿痛、耳鸣、耳聋等阴虚性五官病证；咳嗽、气喘、咯血、胸痛等肺系疾患；消渴，小便频数，便秘；月经不调；腰脊痛，下肢厥冷，内踝肿痛（C错）。阴谷主治癫狂；阳痿、小便不利、月经不调、崩漏等泌尿生殖系统疾患；膝股内侧痛（D错）。